有害和不利的自然环境因素的下列特征，哪项是错误的
A. 历来存在
B. 比次生环境的问题出现早
C. 依然存在
D. 将继续长期存在
E. 将逐渐消失

正确答案：E。将逐渐消失

解析：本题考查自然环境的相关内容。自然环境因素有对健康不利的，也有不少有害的因素。这些因素历来存在，比次生环境的问题出现早，将继续长期存在，不会逐渐消失（E错，为本题正确答案）。